患者，男，45岁。下颌前牙唇侧的牙龈出现黑色斑块样肿物1年余，呈放射状扩展，斑块逐渐扩大，检查双侧下颌下淋巴结肿大。该患者最不应采用的检查的是
A. CT
B. RET
C. MRI
D. 冷冻活检
E. 切取活检

正确答案：E。切取活检

解析：根据题干症状，该患者最可能的诊断是恶性黑色素瘤，不宜行活组织检查，即使是转移性淋巴结亦不应做吸取组织检查，因活检可促使其加速生长，并使肿瘤播散发生远处转移。掌握“恶性黑色素瘤”知识点。